一高中女生18岁，因乳房刺痛来医院就诊，诊室内除了一个女医生外还有一个男医学生，女医生未开口问诊，在让男医学生回避后才开始对患者问诊和查体。女医生让患者实现的权利是
A. 个人隐私权
B. 人身自由权
C. 知情同意权
D. 平等就医权
E. 自主决定权

正确答案：A。个人隐私权

解析：隐私保护权（A对）：医务人员的职业特点决定其有权了解患者与病症诊治有关的一些隐私，但是患也有权维护自己的隐私不受侵害，对于医务人员已经了解的患者隐私，患者享有不被擅自公开的权利；知情同意权（C错）：所谓知情同意，是指在临床过程中，医务人员为患者做出诊断和治疗方案后，应当向患者提供包括诊断结论、治疗决策、病情预后以及诊治费用等方面的真实、充分的信息。